含有甲基三唑杂环，脂溶性大，起效快，催眠作用强，按一类麻药管理的药物是
A. 奥沙西泮
B. 三唑仑
C. 唑吡坦
D. 艾司佐匹克隆
E. 扎来普隆

正确答案：B。三唑仑

解析：本题考查苯二氮䓬类药物。三唑仑（B对）的结构为1，4-苯二氮䓬的1，2位并上了甲基三唑环，其脂溶性加大，易进入中枢系统，为短效镇静催眠药。由于三唑仑致眠作用强，起效快，现已按一类麻醉药管理。奥沙西泮（A错）为苯二氮䓬类镇静催眠药，其基本结构为5位苯基取代的苯二氮䓬，不含有三唑环。唑吡坦和佐匹克隆均为非苯二氮䓬类药物，其中唑吡坦（C错）为咪唑并吡啶结构，佐匹克隆为吡咯酮结构，含有一个手性中心，右旋异构体为艾司佐匹克隆（D错）。扎来普隆（E错）为吡唑并嘧啶杂环结构，不具有甲基三唑杂环的结构。